男性，80岁，上下无牙颌，下颌牙槽嵴低平。全口义齿修复时基托利用其颊棚区作为主承托区是因为此处
A. 正好位于人工牙下方
B. 骨质致密，骨面与咬合力平行
C. 骨质致密，骨面与咬合力垂直
D. 可形成良好边缘封闭
E. 黏膜厚韧

正确答案：C。骨质致密，骨面与咬合力垂直

解析：颊棚区：颊棚区位于下颌后弓区，由近中的颊系带、远中的磨牙后垫和远中颊角区、外侧的下颌骨外斜嵴和内侧的牙槽嵴所围成的区域。随着牙槽嵴的吸收，牙槽嵴高度降低，颊棚区变得平坦、宽阔，由于其表面骨皮质厚、致密，且与咬合力方向垂直，因此能够承受较大的咀嚼压力。掌握“无牙颌的解剖标志及功能分区”知识点。